男性，40岁。低热，乏力伴消瘦1个月，查体：右颈部锁骨下淋巴结肿大，CT示中纵隔伴右侧肺门实性肿物，纵隔淋巴结广泛肿大，血常规检查未见异常。最可能的诊断是
A. 畸胎瘤
B. 支气管囊肿
C. 胸骨后甲状腺肿
D. 食管囊肿
E. 淋巴瘤

正确答案：E。淋巴瘤

解析：患者中年男性，低热、乏力伴消瘦1个月（淋巴瘤常见的全身症状），查体：右颈部、锁骨下淋巴结肿大，CT示中纵隔伴右侧肺门实性肿物，纵隔淋巴结广泛肿大（淋巴结肿大为突出表现是淋巴瘤的特征），血常规检查未见异常可排除血液系统恶性肿瘤引起的淋巴结肿大，故患者最可能的诊断是淋巴瘤（E对）。畸胎瘤（A错）好发颅内、胃、睾丸、卵巢、骶尾部，不伴有淋巴结肿大；支气管囊肿（B错）属于先天性发育异常引起的囊性肿物，无低热，乏力、消瘦等症状，一般不伴有淋巴结肿大；胸骨后甲状腺肿（C错）常伴有明显的压迫症状，无淋巴结肿大；食管囊肿（D错）是位于中纵隔的囊性肿物，一般不伴有淋巴结肿大。